患者，女，29岁，体重45kg，1年前接受了心脏瓣膜置换术，术后一直服用华法林，每天3mg，本次就诊主诉“腹部皮下片状瘀斑”，测INR值为3.5，适宜的处理方案是
A. 维持原剂量给药
B. 停用华法林，换用低分子肝素
C. 停用华法林，换用达比加群酯
D. 华法林适当减量，3日后复测INR
E. 暂停抗凝治疗

正确答案：D。华法林适当减量，3日后复测INR

解析：本题考查华法林。适宜的处理方案是：华法林适当减量，3日后复测INR（D对）。华法林治疗初期需每日监测INR，INR正常值范围为0.8～1.5，华法林应用，目标值为2～3，所以＞4时出血危险性增大，出血可用维生素K₁拮抗，题干中INR值未超过4，可以考虑适当减量，3日后复测INR。